甲苯和二甲苯主要毒性表现为
A. 消化系统毒性
B. 内分泌毒性
C. 皮肤毒性
D. 肾毒性
E. 中枢神经系统毒性

正确答案：E。中枢神经系统毒性